正确的是
A. 由6块骨组成
B. 距骨位于后上方，跟骨位于后下方
C. 大部分属于扁骨
D. 跟骨前端朝向前内方与骰骨相关节
E. 以上都不是

正确答案：B。距骨位于后上方，跟骨位于后下方

解析：跗骨共 7 块（A错），属短骨（C错）。跟骨前端朝向前外方与骰骨相关节（D错）。跗骨后列包括上方的距骨和下方的跟骨（B对）。